与葡萄柚汁同服可能升高血药浓度的药物
A. 维A酸片
B. 左旋多巴片
C. 地衣芽孢杆菌活菌胶囊
D. 非洛地平片
E. 去氨加压素片

正确答案：D。非洛地平片

解析：本题考查饮食对药物疗效的影响。非洛地平片（D对）与葡萄柚汁同服会升高血药浓度。葡萄柚汁主要影响CYP3A4代谢，同时抑制CYP3A4的活性。通过CYP3A4代谢的药物与葡萄柚汁同服会引起生物利用度增加。维A酸（A错）为脂溶性，多食脂肪性食物可促进药物吸收。高蛋白食物在肠内产生大量氨基酸，干扰左旋多巴（B错）由血浆至中枢神经的转移，阻碍吸收。地衣芽孢杆菌活菌胶囊（C错）服用期间不可饮茶。去氨加压素（E错）服药期间应限制饮水。